楮实子的功效有
A. 利尿
B. 补气
C. 滋阴益肾
D. 润肺
E. 清肝明目

正确答案：A、C、E。利尿；滋阴益肾；清肝明目

解析：本题考查的是楮实子的功效。楮实子的功效有利尿（A对）、滋阴益肾（C对）与清肝明目（E对）。楮实子：【功效】滋阴益肾，清肝明目，利尿。人参：【功效】大补元气（B错），补脾益肺，生津止渴，安神益智。哈蟆油：【功效】补肾益精，养阴润肺（D错）。